下列哪个不属于脑干内的副交感核
A. 动眼神经副核
B. 下泌涎核
C. 滑车神经核
D. 迷走神经背核
E. 无

正确答案：C。滑车神经核

解析：脑干内的副交感核包括动眼神经副核（A对）、上泌涎核、下泌涎核（B对）和迷走神经背核（D对），而滑车神经核（C错，为本题正确答案）为一般躯体运动核。